牙周再生性手术包括
A. 改良翻瓣术
B. 引导组织再生术
C. 牙槽骨整形术
D. 牙冠延长术
E. 游离龈瓣移植术

正确答案：B。引导组织再生术

解析：本题考查牙周再生性手术。再生性手术的目的在于获得牙周组织再生，这是理想的牙周治疗结果，主要包括引导性组织再生术（B对）和植骨术。牙周手术分为切除性手术、重建性手术、再生性手术、成形及美学手术。改良翻瓣术（A错）、牙槽骨整形术（C错）属于重建性手术。牙冠延长术（D错）、游离龈瓣移植术（E错）属于成形及美学手术。